非窒息性气体为
A. 硫化氢
B. 甲烷
C. 一氧化碳
D. 二氧化硫
E. 氰化物

正确答案：D。二氧化硫